霍乱的主要临床表现是
A. 腹泻呕吐
B. 烦躁不安
C. 循环衰竭
D. 声音嘶哑
E. 腓肠肌痉挛

正确答案：A。腹泻呕吐

解析：霍乱的主要临床表现是腹泻呕吐（A对）。脱水期的表现如循环衰竭（C错）及脑供血不足缺氧所致烦躁不安（B错），脱水所致声音嘶哑（D错），腓肠肌痉挛（E错）都是在腹泻呕吐基础上严重脱水造成的症状。